正常牙槽嵴顶到釉牙骨质界的距离为
A. 1～2mm，不超过2.5mm
B. 1～1.5mm，不超过2mm
C. 1．5～2mm，不超过3mm
D. 2～3mm，不超过3mm
E. 0．5～2.5mm，不超过3mm

正确答案：B。1～1.5mm，不超过2mm

解析：本题考查正常牙槽嵴顶到釉牙骨质界的距离。龈沟底与牙槽嵴之间约2mm的恒定距离称为生物学宽度，它包括结合上皮（宽约0.97mm）及结合上皮的根方和牙槽嵴顶之间的纤维结缔组织（宽约1.07mm）。牙齿萌出不久时龈沟底位于釉牙骨质界的冠方，此时釉牙骨质界到牙槽嵴顶之间的距离为1～1.5mm，随着牙齿的继续萌出结合上皮逐渐向根方移动，最终结合上沟的冠方即龈沟底与釉牙骨质界处，此时釉牙骨质界至牙槽嵴顶之间的距离为生物学宽度2mm,正常牙齿的生物学宽度恒定不变，所以这一距离不超过2mm（B对）。如果釉牙骨质界至牙槽嵴顶之间的距离超过2mm，说明牙槽嵴顶有吸收，结合上皮处发生了附着丧失，此时这一距离会超过2mm（ACDE错），说明病变进展至牙周炎。